慢性苯中毒主要损害
A. 神经系统
B. 循环系统
C. 血液系统
D. 消化系统
E. 泌尿系统

正确答案：C。血液系统